尊重患者知情同意权，其正确的做法是
A. 婴幼患儿可以由监护人决定其诊疗方案
B. 家属无承诺，即使患者本人知情同意也不得给予手术
C. 对特殊急诊患者的抢救都同样对待
D. 无须做到患者完全知情
E. 只经患者同意即可手术

正确答案：A。婴幼患儿可以由监护人决定其诊疗方案

解析：这种传统的伦理决策以患者利益为优先考虑，由医生做出，可与同行商议。在研究中，知情同意是标准规则，但多以具体境遇考虑，少以一般规则来衡量。婴幼患儿可以由监护人决定其诊疗方案体现了尊重患者知情同意权（A对）。代理知情同意的合理性和必要性取决于代理人见能够真实反映患者的意志（B错）。有对于急救患者，建议患者家属慎用拒绝权并做好解释说明工作。因为医师提出的急救措施往往直接关系到患者的生命安全。家属由于医疗知识所限，不容易做出准确判断（C错）。完全知情是指患者获悉他作出承诺所必需的医学信息，即通过医方翔实的说明和介绍、对有关询问的必需回答和解释，患者全面了解诊治决策的利与弊，例如诊治的性质、作用、依据、损伤、风险、意外等。医方使患者知情的方式一般是口头的，必要时则辅之书面文字方式（D错）。医师的道德权利还有要求患者及其家属配合诊治、对患者的不当行为进行特殊干涉等，所以不能只经患者同意做手术（E错）。